设某人的肺通气量为7500m/min，呼吸频率为20次/分，无效腔容量为125ml。每分肺血流量为5L，他的通气血流比值应是
A. 0.7
B. 0.8
C. 0.9
D. 1
E. 1.1

正确答案：D。1